男，55岁。左下肢麻木胀痛3年，间歇性跛行1年，左下肢疼痛逐渐加重，夜间疼痛更甚。吸烟史30年。查体：屈膝位，左小腿皮温较对侧降低，左侧足背动脉搏动消失。对该患者有助于诊断的实验是
A. Perthes实验
B. Buerger试验
C. Pratt试验
D. Homans试验
E. Trendelenburg试验

正确答案：B。Buerger试验

解析：中年男性患者，长期吸烟史（血栓闭塞性脉管炎的高危因素）。左下肢麻木胀痛3年，间歇性跛行1年（提示下肢供血不足），疼痛逐渐加重，夜间明显（静息痛）。体查：左小腿皮温较对侧低（提示动脉供血不足），左侧足背动脉搏动消失（提示动脉近端狭窄）。综合该患者的病史及体查，诊断考虑血栓闭塞性脉管炎，对该患者有助于诊断的实验是Buerger试验（B对）。其具体操作为：先抬高下肢70°～80°，或高举上肢过头，持续60秒，正常肢体远端皮肤保持淡红或稍发白，如呈苍白或蜡白色，提示动脉供血不足；再将下肢下垂于床沿或上肢下垂于身旁，正常人皮肤色泽可在10秒内恢复，如恢复时间超过45秒，且色泽不均匀者，进一步提示动脉供血障碍。Perthes试验（A错）用于检测深静脉回流通畅与否；Pratt试验（C错）用于检测交通静脉瓣膜功能；Trendelenburg试验（E错）用于检测大隐静脉瓣膜功能。Homans试验（P503）（D错）也称踝关节过度背屈试验，阳性提示小腿深静脉血栓形成。